与幽门螺杆菌感染关系密切的疾病是
A. 克罗恩病
B. 十二指肠溃疡
C. 胃食管反流病
D. 功能性消化不良
E. 溃疡性结肠炎

正确答案：B。十二指肠溃疡

解析：与幽门螺杆菌感染关系密切的疾病是十二指肠溃疡（B对）和胃溃疡。胃食管反流病（C错）与食管下括约肌功能障碍有关。功能性消化不良（D错）多与胃肠动力不足有关。克罗恩病（A错）与溃疡性结肠炎（E错）目前发病机制不明确，由环境、遗传、感染和免疫多因素相互作用所致。